伤寒第一次菌血症相当于临床上的哪一期
A. 潜伏期
B. 初期
C. 极期
D. 缓解期
E. 恢复期

正确答案：A。潜伏期

解析：未被胃酸杀灭的伤寒杆菌进入小肠后，人侵肠黏膜，部分病菌被吞噬细胞吞噬，并在其胞质内繁殖，部分进入小肠集合淋巴结和肠系膜淋巴结，经胸导管进入血流，引起短暂的菌血症，即伤寒第一次菌血症；此阶段患者无症状，相当于临床潜伏期（A对）。若免疫力低下，则细菌随血流进入肝、胆、脾、肾、骨髓及回肠末端的孤立淋巴结、继续在单核-吞噬细胞系统内大量繁殖，再次进入血流，形成第二次严重菌血症，并释放内毒素，患者即出现发热、全身不适、玫瑰疹和肝脾肿大等。